逆温是指
A. 随着高度的增加，气温上升
B. 随着高度的增加，气温下降
C. 随着高度的降低，气温不变化
D. 随着气压的增加，气温升高
E. 随着气压的增加，气温下降

正确答案：A。随着高度的增加，气温上升

解析：本题考查逆温。逆温是指随着高度的增加，气温上升（A对BCDE错）。